关于地西泮的作用特点,哪项是错误的
A. 小于镇静剂量时即有抗焦虑作用
B. 产生镇静剂量时可引起暂时性记忆缺失
C. 可增强其他中枢抑制药的作用
D. 剂量加大可引起麻醉
E. 有良好的抗癫痫作用

正确答案：D。剂量加大可引起麻醉